以下哪一种作用与氨茶碱平喘机制无关
A. 阻断H₁受体
B. 促儿茶酚胺类物质释放
C. 阻断腺苷受体
D. 抗炎作用，减少炎性细胞浸润
E. 抑制磷酸二酯酶

正确答案：A。阻断H₁受体